水银血压计与电子血压计的指示允许误差范围是
A. ±1.875和±1.875
B. ±3.75和±4
C. ±3.75和±5.625
D. ±5.625和±5.625
E. ±5.625和±7.5

正确答案：B。±3.75和±4

解析：本题考查血压计的误差。电子血压计允许误差为±4mmhg，水银血压计允许误差为±3.75mmhg（B对）。